从百合科植物丽江山慈菇的球茎中得到的一种生物碱，能抑制细胞有丝分裂，有一定的抗肿瘤作用，可以控制尿酸盐对关节造成的炎症，可在痛风急症时使用的药物是
A. 别嘌醇
B. 非布索坦
C. 苯溴马隆
D. 丙磺舒
E. 秋水仙碱

正确答案：E。秋水仙碱

解析：本题考查抗痛风药的作用机制。秋水仙碱（E对）是来源于天然物丽江山慈菇，长期使用会产生骨髓抑制毒性副作用的抗痛风药物。别嘌醇（A错）是通过抑制黄嘌呤氧化酶来抑制尿酸生成的药物，可以降低血中尿酸的浓度，减少尿酸在关节等处的沉积。非布索坦（B错）为目前世界上最新研制的黄嘌呤氧化酶抑制剂，其通过高度选择性地作用于该氧化酶，减少体内尿酸合成，降低尿酸浓度，从而有效治疗痛风。苯溴马隆（C错）的抗痛风机制主要是通过抑制肾小管对尿酸的重吸收，从而降低血中的尿酸浓度。丙磺舒（D错）抑制尿酸盐在近曲小管的主动重吸收，增加尿酸的排泄而降低血中尿酸盐的浓度。